化学结构与毒效应
A. 化合物的化学结构决定理化性质
B. 理化性质决定化合物的生物活性
C. 化合物的生物活性决定该化合物的化学活性
D. 化合物的化学结构决定其化学活性及理化性质

正确答案：D。化合物的化学结构决定其化学活性及理化性质

解析：本题考查化学结构与毒效应。化学结构是决定化学物毒性的物质基础，化合物的化学结构决定其化学活性及理化性质（D对ABC错）。